1.0g及1.0g以下颗粒剂的装量差异限度是
A. ±15%
B. ±10%
C. ±8%
D. ±7%
E. ±5%

正确答案：B。±10%